牙本质过敏的发生机制被认为是
A. 体液学说
B. 化学细菌学说
C. 活体学说
D. 流体动力学说
E. 蛋白溶解学说

正确答案：D。流体动力学说

解析：本题考查牙本质过敏的发生机制。关于牙本质过敏症疼痛发生机制，代表性的学说有3个：神经终末传导学说，成牙本质细胞传导学说和液体动力学说（D对）。神经终末传导学说认为牙本质中存在传导痛觉的牙髓神经；成牙本质细胞传导学说认为牙本质细胞突起传导痛觉；液体动力学说认为由牙本质小管内液体的流动传到牙髓，刺激牙髓神经纤维兴奋产生痛觉。体液学说（A错）、化学细菌学说（B错）、活体学说（C错）、蛋白溶解学说（E错）属于龋病的病因学说。